女性，26岁。左颈及腋下有无痛性肿块，体检时发现在左侧颈部、锁骨上和腋窝等处有肿大的无痛性孤立的淋巴结。可以归为B组的是
A. 乏力
B. 瘙痒
C. 疼痛
D. 体重减轻10%
E. 盗汗

正确答案：D。体重减轻10%